甲亢病人的手术禁忌症是
A. 妊娠早期重度甲亢
B. 高功能腺瘤
C. 中高Graves病
D. 青少年患者
E. 胸骨后甲状腺肿伴甲亢

正确答案：D。青少年患者

解析：甲状腺激素对青少年的生长发育至关重要。青少年甲亢患者接受甲状腺手术后容易出现持久性的甲状腺功能减低，影响生长发育，因此，青少年患者（D对）为手术禁忌证。甲亢手术治疗指征为：①继发性甲亢或高功能腺瘤（B错）；②中度以上的Graves病（C错）；③腺体较大，伴有压迫症状，或胸骨后甲状腺肿伴甲亢（E错）；④抗甲状腺药物或¹³¹I治疗后复发者或坚持长期用药有困难者。⑤妊娠早、中期的甲亢病人凡具有上述指征者，应考虑手术治疗，并可以不终止妊娠（A错）。